某药厂销售代表在和某县医院几名医师达成协议后，医师在处方时使用该药厂生产的药品，并按使用量的多少收受了药厂给予的提成。事情曝光后，对该药厂按《药品管理法》的有关规定处理；对于医师的错误行为，有权决定给予错误处分、没收违法所得的部门是
A. 药品监督管理部门
B. 工商行政管理部门
C. 医师协会
D. 消费者权益保护费
E. 卫生行政部门

正确答案：E。卫生行政部门

解析：对于医师的行为，应为卫生行政部门予以处罚。掌握“药品管理及法律责任”知识点。